肝病日久，两胁胀满疼痛，并见舌质瘀斑、瘀点。其病机是归中医诊断学
A. 气滞血瘀
B. 气不摄血
C. 气随血脱
D. 气血两虚
E. 气血失和

正确答案：A。气滞血瘀

解析：两胁胀满疼痛为气滞的表现，血瘀也可致两胁疼痛，舌质瘀斑、瘀点为血瘀的表现，为气滞与血瘀并见，故其病机为气滞血瘀（A对）。气不摄血证指慢性出血与气虚的证候同见，故（B错）。气随血脱证指大量出血与阳气虚衰的证候同见，故（C错）。气血两虚证指气虚和血虚的证候兼并出现，故（D错）。气血失和证指气血失去相互协调的作用（E错）。